约在第1腰椎高度起于腹主动脉前壁的动脉有
A. 肠系膜上动脉
B. 肠系膜下动脉
C. 肾动脉
D. 第1对腰动脉
E. 以上都不对

正确答案：A。肠系膜上动脉

解析：肠系膜上动脉（A对）约在第1腰椎高度起于腹主动脉前壁。